以下属于公共卫生工作特有的伦理原则是
A. 生命价值原则
B. 尊重自主原则
C. 最优化原则
D. 隐私保密原则
E. 公众参与原则

正确答案：E。公众参与原则

解析：公共卫生就是组织社会共同努力，改善环境卫生条件，预防控制传染病和其他疾病流行，培养良好卫生习惯和文明生活方式，提供医疗服务，达到预防疾病，促进入民身体健康的目的。因此，公共卫生建设需要国家、社会、团体和民众的广泛参与，共同努力（E对）。生命价值原则（A错）和最优化原则（C错）体现在树立全面的利益观，真诚关心病人的以生命和健康为核心的客观利益和主观利益：提供最优化服务，努力使病人受益。尊重自主原则（B错）即尊重患者的自主权利，医生尊重病人的自主性，保证病人自己做主、理性地选择诊疗方式和手段。隐私保密原则（D错）体现在尊重患者的隐私权，医疗职业使医生常常可以了解到病人的某些隐私，对病人这些隐私，医务人员要保密，否则泄露出去会给病人造成身心上的伤害。以上四个原则基本上属于临床工作伦理原则，用于调节医患关系。